对牙髓刺激作用小，粘结力较高的材料
A. 磷酸锌粘固剂
B. 树脂类粘固剂
C. 聚羧酸粘固剂
D. 玻璃离子粘固剂
E. 氧化锌丁香油粘固剂

正确答案：C。聚羧酸粘固剂

解析：聚羧酸粘固剂：对牙髓刺激作用小，粘结力较高。掌握“修复体试戴、磨光与粘固”知识点。